与后腭杆相比，前腭杆的特点为
A. 厚而宽，厚度约1.5～2mm，宽度约3.5mm
B. 薄而宽，厚度约1～1.5mm，宽度约3～3.5mm
C. 薄而宽，厚度约1mm，宽度约8mm
D. 薄而宽，厚度约0.5mm，宽度约5mm
E. 厚而宽，厚度约2mm，宽度约5mm

正确答案：C。薄而宽，厚度约1mm，宽度约8mm

解析：本题考查前腭杆的特点。腭杆分前腭杆、后腭杆、侧腭杆三种。前腭杆在腭隆突前部，腭皱襞后部，与舌接触，所以制作的薄而宽，厚约1mm，宽约6～8mm（C对），不影响发音且舌感舒适；后腭杆位于腭隆突之后，颤动线之前，因不与舌体接触，可适当增加厚度，提高强度，即厚而宽，厚度约1.5～2mm，宽度约3.5mm（A错）；侧腭杆用于连接前后腭杆位于腭隆突两侧，与牙弓并行，厚度约1～1.5mm，宽度约3～3.5mm。